心的血液循环中
A. 左半心仅由左冠状动脉营养
B. 冠状窦收集了心全部的静脉血
C. 左心室后壁由左、右冠状动脉共同营养
D. 人群中所有的窦房结仅由右冠状动脉营养
E. 心的血循环为功能型血液循环

正确答案：C。左心室后壁由左、右冠状动脉共同营养

解析：左半心不仅（A错）由左冠状动脉营养，左心室后壁由左、右冠状动脉共同营养（C对）。冠状窦收集了心大部分（B错）的静脉血，有些小静脉可以直接注入心腔。人群中所有的窦房结不仅（D错）由右冠状动脉营养，约40%的人的窦房结由左冠状动脉的旋支营养。